根据药性及治疗疾病的不同，药物的服用时间也各不相同。适宜饭前服用的中成药有
A. 牛黄清火丸
B. 六味地黄丸
C. 保和丸
D. 参苓白术散
E. 大山楂丸

正确答案：B、D。六味地黄丸；参苓白术散

解析：本题考查的是患者合理用药教育中的服药时间。适宜饭前服用的中成药有六味地黄丸（B对）、参苓白术散（D对）。饭前服：补益药宜饭前服以利于吸收，如六味地黄丸、参苓白术散等；制酸药宜饭前服，以减少胃酸分泌，增强对胃黏膜的保护；病在胸膈以下，如肝、肾等脏器疾病宜饭前服，旨在使药力直达病所，发挥最佳效力。牛黄清火丸（A错）【功能主治】清热，散风解毒。用于肝胃肺蕴热，引起的头晕目眩，口鼻生疮，风火牙痛，咽喉肿痛，痄腮红肿，耳鸣肿痛。【禁忌】孕妇忌服。饭后服：对胃肠道有刺激的药物及苦寒伤胃之药宜饭后服；健胃消食药宜饭后服，如保和丸（C错）、大山楂丸（E错）等；病在胸膈以上，如头痛、眩晕、目疾、咽痛等宜饭后服，使药力停留于上焦，便于发挥药效。